下列高钙血症对机体的影响哪项是不正确的？
A. 神经肌肉兴奋性下降
B. 主要损害肾小管
C. 心肌兴奋性、传导性均升高
D. 异位钙化
E. 严重高血钙可产生高血钙症危象

正确答案：C。心肌兴奋性、传导性均升高

解析：Ca2＋参与维持神经-肌肉的兴奋性，当血浆Ca2＋的浓度升高时，神经-肌肉的兴奋性降低（A对）。Ca2＋对肾的损害主要在肾小管（B对），表现为肾小管水肿、坏死、基底膜钙化。Ca2＋对心肌细胞 Na＋内流具有竞争性抑制作用，称为膜屏障作用，高血钙时膜屏障作用增强，心肌兴奋性和传导性降低（C错）。高血钙常引起异位钙化灶的形成（D对），多出现在关节、肾、软骨等处。严重高血钙可产生高钙血症危象（E对），表现为严重脱水、高热、心律失常、意识不清等。